下列关于牙种植概念的叙述，恰当的一项是
A. 将未发育完成的牙胚植入牙槽骨内的手术
B. 将人工牙植入牙槽骨内的手术
C. 将自体牙植入牙槽骨内的手术
D. 将异体牙植入牙槽骨内的手术
E. 将脱位牙植入牙槽骨内的手术

正确答案：B。将人工牙植入牙槽骨内的手术

解析：牙种植是将人工牙（通常指人工牙根假体）植入牙槽骨内的手术。该植入物称为牙种植体，牙种植体是指为了支持义齿修复的上部结构，用外科手段在上颌或下颌骨内或颌骨上植入设计的装置。掌握“牙种植术概论”知识点。